“胎儿油症”主要因为孕妇食用了何种化合物污染的米糠油所致
A. 酚
B. 多氯联苯
C. 多环芳烃
D. 甲基汞
E. 二噁英

正确答案：B。多氯联苯

解析：本题考查胎儿油症。胎儿油症是指孕妇食用被多氯联苯（B对ACDE错）污染的米糠油后，出现胎儿死亡，新生儿体重减轻，皮肤颜色异常，眼分泌物增多等情况。